十二经脉中，相表里的阴经和阳经的交接部位在
A. 胸腹部
B. 胸部
C. 腹部
D. 指（趾）内侧端
E. 四肢内侧

正确答案：D。指（趾）内侧端

解析：十二经脉的交接中，相为表里的阴经与阳经在手足末端交接（D对）。相互衔接的阴经与阴经在胸中交接（B错）。同名的阳经与阳经在头面部交接。